急性乙型肝炎最早出现异常的血清学标志是
A. HBsAg
B. 抗-HBs
C. HBeAg
D. 抗-HBe
E. 抗-HBc

正确答案：A。HBsAg

解析：HBsAg（A对）是HBV感染的血清学标志，最早感染后1～2周出现；HBsAg能刺激机体产生保护性抗体抗-HBs（B错），HBsAg消失后数天至数月才可检测到抗HBs；HBeAg（C错）在HBV感染后与HBsAg同时或稍后出现；抗HBe（D错）在HBeAg消失后产生；HBcAg存在于HBV颗粒的核心及感染的肝细胞核内，血液中不易检出，但其抗原性强，于感染后早期即可刺激机体产生抗HBc（E错），抗HBcIgG出现较迟，见于急性感染恢复期和慢性感染期。